患者，女，42岁。颈部皮肤有7-8个细软的丝状突起，呈褐色，自行脱落后又有新的长出。其诊断是
A. 寻常疣
B. 传染性软疣
C. 扁平疣
D. 丝状疣
E. 掌跖疣

正确答案：D。丝状疣

解析：患者为中年妇女，颈部见褐色丝状突起，自行脱落后又有新的长出，符合丝状疣的诊断标准（D对）。寻常疣初为一个疣状赘生物，呈半球形或多角形，突出表面，色灰白或污黄，表面蓬松枯槁，状如花蕊，粗糙而坚硬，此为原发性损害，称母疣，此后由于自身接种，数目增多（A错）。传染性软疣皮损为半球形丘疹，中央有脐凹，表面有蜡样光泽，挑破顶端可挤压出白色乳酪样物质，呈散在性或簇集性分布（B错）。扁平疣皮损为表面光滑的扁平丘疹，呈淡红色、褐色或正常皮肤颜色。散在分布，或簇集成群（C错）。跖疣皮损为角化性丘疹，中央稍凹，外周有稍带黄色高起的角质环，除去表面角质后，或见疏松的白色乳头状角质物，掐或挑破后易出血，有明显的压痛（E错）。